不属于湿啰音特点的是
A. 断续
B. 短暂
C. 连续多个
D. 性质不变
E. 部位易变

正确答案：E。部位易变

解析：湿啰音是由于吸气时气体通过呼吸道内的分泌物如渗出液、痰液、血液、黏液和脓液等，形成的水泡破裂所产生的声音。湿啰音为呼吸音的附加音，断续而短暂（AB对），一次常连续多个出现（C对），于吸气时或呼气时终末为明显，部位较恒定（E错，为本题正确答案），性质不易变（D对），咳嗽后可减轻或消失。